接触麻疹的易感者需检疫观察的时间是
A. 5天
B. 21天
C. 7天
D. 10天
E. 14天

正确答案：B。21天

解析：麻疹潜伏期约10日（6～21天），曾接触过被动或主动免疫者，可延至3～4周。早期发现患者，早期隔离。一般病人隔离至出疹后5天，合并肺炎者延长至10天。接触麻疹的易感者应检疫观察3周，21天（B对），采取这样的措施可以更好的控制传染源，从而减少传染病的发病率。